患者，女，23岁。患乳腺纤维瘤，左乳肿块坚硬光滑，伴有情志抑郁，心烦易怒，失眠多梦，舌苔薄白，脉弦滑。其治法是
A. 疏肝理气，化痰软坚
B. 调理冲任，温阳化痰
C. 养阴清热，化痰软坚
D. 清热解毒，通乳散结
E. 疏肝解郁，清热凉血

正确答案：A。疏肝理气，化痰软坚

解析：患者西医诊断：乳腺纤维瘤，中医诊断为乳癖，伴随症状有情志抑郁，心烦易怒，失眠多梦，舌苔薄白，是为肝失疏泄，气机不畅，痰湿困于体内不得疏导引起气滞，扰乱心神，故治疗要疏肝理气，化痰软坚（A对）。若患者冲任失调，即乳房肿块月经前加重，经后缓解，并伴有腰酸乏力，神疲倦怠，月经失调等症状，治疗要调摄冲任（B错）。养阴清热，化痰散结多用于治疗阴虚发热等证候（C错）。清热解毒，通乳散结多用于热毒内盛，津液蕴蒸引起血瘀等证候（D错）。疏肝解郁，清热凉血多用于肝郁化热，血热妄行等证候（E错）。